维生素A转化为2，6-顺式维生素A的变化属于
A. 水解
B. 氧化
C. 异构化
D. 聚合
E. 脱羧

正确答案：C。异构化

解析：本题考查药物的降解途径。维生素A转化为2，6-顺式维生素A的变化属于异构化（C对）。异构化是有机物分子中原子或基团的位置改变，通常会使药物的生理活性降低甚至没有活性，维生素A转化为2，6-顺式维生素A就是异构化过程，其生理活性也降低。水解（A错）是药物降解的主要途径。属于这类降解的药物主要有酯类、酰胺类等。氧化（B错）是氧元素与其他物质元素发生的变化。聚合（D错）是两个或多个分子结合在一起形成复杂分子的过程。脱羧（E错）是在特殊情况下，羧酸脱去羧基的反应。